具有选择性延长APD和ERP功能的药物是
A. 利多卡因
B. 维拉帕米
C. 奎尼丁
D. 普萘洛尔
E. 胺碘酮

正确答案：E。胺碘酮

解析：本题考查胺碘酮。胺碘酮（E对）具有选择性延长APD和ERP功能。APD表示动作电位时程，ERP表示心内膜下复苏比。胺碘酮为延长动作电位时程药。利多卡因（A错）属于钠通道阻滞剂Ⅰb类抗心律失常药，仅用于室性心律失常。维拉帕米（B错）为钙通道阻滞剂，用于心绞痛，室上性心律失常，原发性高血压。奎尼丁（C错）属于钠通道阻滞剂Ⅰa类抗心律失常药。普萘洛尔（D错）为β受体阻断剂，可用于治疗由β受体介导的心律失常。